女，60岁。食欲不振，腰背部胀痛半年，皮肤逐渐黄染，大便灰白色3个月。发病以来体重下降10kg。查体：T36.5℃，P80次/分，R18次/分，BP120/80mmHg，皮肤巩膜黄染，心肺查体未见明显异常，腹部无压痛、肌紧张，右肋下可触及肿大胆囊，无触痛。实验室检查：血胆红素78μmol/L，直接胆红素65μmol/L。首选的手术方式是
A. 右半肝切除术
B. 肝门部胆管癌切除术
C. 胰头十二指肠切除术
D. 右半结肠切除术
E. 胃癌根治术

正确答案：C。胰头十二指肠切除术

解析：老年女性患者，腰背部胀痛，食欲不振，体重下降，皮肤逐渐黄染，大便灰白色，血胆红素和直接胆红素升高。右肋下可触及肿大胆囊，无触痛（Courvoisier征）。Courvoisier征是指在胰头癌压迫胆总管导致阻塞时，发生明显黄疸，且逐渐加深，胆囊显著肿大，但无压痛，称为Courvoisier征，又称胆总管渐进阻塞征。多见于胰头癌，胆管下端癌。因此首先考虑的诊断是胰头癌。首选的手术方式是胰头十二指肠切除术（C对）。